狂犬病毒主要侵犯
A. 肠黏膜上皮细胞
B. 肠黏膜上皮细胞外
C. 呼吸道黏膜上皮细胞
D. 神经组织
E. 肺组织

正确答案：D。神经组织

解析：狂犬病（rabies）是由狂犬病毒（rabies virus）引起的以侵犯中枢神经系统为主的人兽共患急性传染病（D对）。流感病毒进人呼吸道后，NA破坏神经氨酸，使纤毛柱状上皮细胞表面的黏蛋白水解，HA受体暴露（C对）。诺如病毒主要侵犯肠黏膜上皮细胞（A错）。SARS-CoV侵犯肺组织细胞（E错）。